男，62岁。上腹胀、隐痛2个月，伴食欲减退、乏力、消瘦、大便发黑。查体：消瘦，浅表淋巴结无肿大，双肺呼吸音清，未闻及干湿啰音，心律齐，腹软，无压痛。上消化道钡剂造影见胃窦部小弯侧粘膜紊乱，可见直径3.5cm不规则充盈缺损，胃壁僵直。其最常见的扩散转移途径是
A. 直接浸润
B. 腹腔内种植
C. 胃肠道内转移
D. 淋巴结转移
E. 血行转移

正确答案：D。淋巴结转移

解析：患者老年男性，（胃癌好发年龄在50岁以上，男女发病率之比约为2：1）。上腹胀、隐痛2个月，伴食欲减退、乏力、消瘦、大便发黑（胃癌症状，肿瘤破溃或侵犯胃周血管后可有呕血、黑便等消化道出血症状）。查体：消瘦，浅表淋巴结无肿大，双肺呼吸音清，未闻及干湿啰音，心律齐，腹软，无压痛。上消化道钡剂造影见胃窦部小弯侧粘膜紊乱，可见直径3.5cm不规则充盈缺损，胃壁僵直（进展期胃癌钡剂造影征象主要有龛影、充盈缺损、胃壁僵硬胃腔狭窄、黏膜皱襞改变，蠕动异常和排空障碍），综上，患者可以诊断为胃癌，胃癌可经直接浸润（A错）、腹腔内种植（B错）、血行转移（E错）等途径转移，但主要转移途径是淋巴转移（D对）（P346）。